前列腺增生症鉴别诊断下列哪项无意义
A. 前列腺癌和膀胱癌
B. 神经原性膀胱
C. 膀胱颈硬化
D. 前列腺炎
E. 尿道狭窄

正确答案：D。前列腺炎